选择性阻断β₁受体的是
A. 普萘洛尔
B. 拉贝洛尔
C. 阿托品
D. 酚妥拉明
E. 美托洛尔

正确答案：E。美托洛尔